又称为乳儿期的是
A. 胎儿期
B. 婴儿期
C. 围产期
D. 新生儿期
E. 幼儿期

正确答案：B。婴儿期

解析：本题考查小儿年龄分期。婴儿期（B对）又称为乳儿期，出生后至满1周岁之前，新生儿期包括在内。